男，10岁。发现眼睑水肿3天，尿如深茶色1天，病前3周曾患皮肤脓疱疮。查体：血压130/90mmHg，心率110次/分，肝于右肋下1cm，有压痛，双下肢轻度凹陷性水肿。目前首选的治疗措施是给予
A. 限制钠盐吸入
B. 青霉素
C. 呋塞米
D. 氢氯噻嗪
E. 卡托普利

正确答案：C。呋塞米

解析：患儿3周前曾有皮肤感染，现出现水肿、血尿（深茶色）、高血压，提示急性肾小球肾炎。由于患儿肝肿大且有压痛，提示有严重的循环充血，需尽快予以利尿对症治疗，首选强效利尿剂呋塞米（C对）。利尿同时注意血压变化及电解质紊乱。